用16种人格因素测验量表（16PF）测验某人的人格特征，这一方法依据的是下列哪种理论
A. 艾森克人格理论
B. 卡特尔人格理论
C. 弗洛伊德人格理论
D. 斯金纳的人格理论
E. 罗杰斯的人格理论

正确答案：B。卡特尔人格理论

解析：卡特尔人格理论是通过因素分析法得出16个人格因素，含180多个题目。16PF已在我国试用，对于选拔人才和职业咨询等有一定的参考价值。掌握“常用的心理测验及临床评定测量表”知识点。